根据《中华人民共和国环境影响评价法》，正确的是
A. 环境影响评价评价报告内容不包括预防不良环境影响的对策和措施
B. 环境影响评价是一种方法
C. 环境影响评价是种制度
D. 环境影响评价既是方法又是制度
E. 环境影响评价仅评价对环境、生态的影响，不考虑对健康影响

正确答案：D。环境影响评价既是方法又是制度

解析：本题考查《中华人民共和国环境影响评价法》。环境影响评价是指对规划和建设项目实施后可能造成的环境影响进行分析、预测和评估，提出预防或者减轻不良环境影响的对策和措施（A错），并进行跟踪监测的方法与制度。环境影响评价工作既是一种方法又是一种制度（D对BC错），目的是为了预防因规划和建设项目实施后对环境及人类健康造成不良影响（E错）。